正确描述肾静脉的是
A. 右肾静脉较粗、较长
B. 注入门静脉
C. 左肾静脉收纳左睾丸静脉
D. 经肾动脉后方横行注入下腔静脉
E. 注入下腔静脉高度平第2-3腰椎间

正确答案：C。左肾静脉收纳左睾丸静脉

解析：左肾静脉（A错）比右肾静脉长。左肾静脉接受左睾丸静脉（C对）和左肾上腺静脉。经肾动脉前面（D错）向内行注入下腔静脉。